胰岛素绝对不足，起病快，病情重的是
A. 1型糖尿病
B. 妊娠糖尿病
C. 2型糖尿病
D. 遗传缺陷糖尿病
E. 免疫介导糖尿病

正确答案：A。1型糖尿病

解析：本题考查1型糖尿病。胰岛素绝对不足，起病快，病情重的是1型糖尿病（A对）。糖尿病主要分为两种类型：①胰岛素依赖型糖尿病（即1型糖尿病），此型患者起病较快，病情较重，需要终生应用胰岛素替代治疗。②非胰岛素依赖型糖尿病（即2型糖尿病）（C错），患者起病较慢，病情较轻，体型多肥胖。其它特殊类型的糖尿病，包括某些遗传缺陷（D错）、胰腺病变、内分泌病变等。妊娠糖尿病（B错）是妊娠过程中初次发现的任何程度的糖耐量异常。免疫介导糖尿病（E错）是因免疫异常导致自身β细胞减少而导致的糖尿病。